弗洛伊德提出五个阶段的性发展理论，“肛门期”在
A. 出生至一岁半时期
B. 一岁半至三岁时期
C. 四至六岁儿童期
D. 七至十二岁的儿童期
E. 十三岁以上青春期及成人期

正确答案：B。一岁半至三岁时期